不是光化学烟雾的主要成分的物质是
A. 过氧乙酰硝酸酯
B. 臭氧
C. 过氧苯酰硝酸酯
D. 甲醛
E. CO

正确答案：E。CO

解析：本题考查光化学烟雾的成分。光化学烟雾的成分复杂，包括臭氧（B对）、过氧酰基硝酸酯（AC对）（PANs）和醛类（D对）等多种成分。一氧化碳（E错，为本题正确答案）不是光化学烟雾的主要成分。